阳性结果最有助于排除肺血栓栓塞的检查是
A. 心电图
B. 胸部X线
C. 血D-二聚体
D. 下肢深静脉彩超
E. 动脉血气分析

正确答案：A。心电图

解析：肺血栓栓塞大多数病例呈非特异性心电图异常，最常见为窦性心动过速，阳性结果有助于排除肺血栓栓塞的检查（A对）。肺血栓栓塞患者，胸部X线片可显示肺动脉阻塞征，肺动脉高压征及右心扩大征，肺组织继发改变的阳性表现（B错）。PTE时血D-二聚体升高，不能排除（C错）。下肢为DVT最多发部位，超声检查可诊断DVT（D错）。动脉血气分析，常表现为低氧血症、低碳酸血症，阳性结果不能排除PTE（E错）。